下列说法错误的是
A. 生物转化是机体维持稳态的主要机制
B. 外源化合物生物转化酶所催化的反应分Ⅰ相反应和Ⅱ相反应
C. 一般说来，生物转化使外源化合物水溶性增加，毒性降低
D. 以上说法都不对

正确答案：D。以上说法都不对

解析：本题考查生物转化的相关内容。生物转化是指化学毒物经过酶催化后化学结构发生改变的代谢过程，即毒物出现了质的变化。生物转化是机体维持稳态的主要机制（A对）。一般说来，生物转化使外源化合物水溶性增加，毒性降低（C对）。外源化合物生物转化酶所催化的反应分Ⅰ相反应和Ⅱ相反应（B对）。以上几种说法都是正确的（D错，为本题正确答案）。